在复方乙酰水杨酸片中，可以有效延缓乙酰水杨酸水解的辅料是
A. 滑石粉
B. 轻质液体石腊
C. 淀粉
D. 15%淀粉浆
E. 1%酒石酸

正确答案：E。1%酒石酸

解析：本题考查乙酰水杨酸的辅料。复方乙酰水杨酸片中加入乙酸水杨酸量1%的酒石酸（E对），可在湿法制粒过程中有效地减少乙酰水杨酸水解。